抑制PG合成酶作用最强的药物是
A. 阿司匹林
B. 吲哚美辛
C. 保泰松
D. 对乙酰氨基酚
E. 布洛芬

正确答案：B。吲哚美辛